外感风邪头痛、头风，治宜选用
A. 消风散
B. 二陈汤
C. 川芎茶调散
D. 天麻钩藤饮
E. 半夏白术天麻汤

正确答案：C。川芎茶调散

解析：本题考查方剂的主治，属于理解记忆内容。川芎茶调散主治外感风邪头痛（C对）。消风散主治风疹、湿疹，不能用于治疗外感风邪头痛、头风（A错）。二陈汤主治湿痰证，不能用于治疗外感风邪头痛、头风（B错）。天麻钩藤饮主治肝阳偏亢，肝风上扰证，不能用于治疗外感风邪头痛、头风（D错）。半夏白术天麻汤主治风痰上扰证，不能用于治疗外感风邪头痛、头风（E错）。趣记：川芎茶调散 薄荷老戒放枪，穷仔细。――薄荷老芥防羌，芎芷细。